可作为气雾剂表面活性剂的是
A. 乙醇
B. 七氟丙烷
C. 聚山梨酯
D. 维生素C
E. 液状石蜡

正确答案：C。聚山梨酯

解析：本题考查气雾剂的表面活性剂。气雾剂常加入的表面活性剂包括聚三梨酯类（C对），特别是聚三梨酯-80。